鼠伤寒沙门菌D55℃=10，是指
A. 在55℃10分钟可减弱食品中90%鼠伤寒沙门菌
B. 在55℃10分钟可杀死食品中90%鼠伤寒沙门菌
C. 在55℃10秒钟可减弱食品中90%鼠伤寒沙门菌
D. 在55℃10秒钟可杀死食品中90%鼠伤寒沙门菌
E. 在55℃10分钟食品中90%鼠伤寒沙门菌不能繁殖

正确答案：B。在55℃10分钟可杀死食品中90%鼠伤寒沙门菌